甘草反
A. 白及
B. 白芍
C. 五灵脂
D. 贝母
E. 京大戟

正确答案：E。京大戟

解析：本题考查的是十八反内容。甘草反京大戟（E对）。十八反列述了三组相反药，分别是：甘草反甘遂、京大戟、海藻、芫花；乌头（川乌、附子、草乌）反半夏、瓜蒌（全瓜蒌、瓜蒌皮、瓜蒌仁、天花粉）、贝母（D错）（川贝、浙贝）、白蔹、白及（A错）；藜芦反人参、南沙参、丹参、玄参、苦参、细辛、芍药（赤芍、白芍（B错））。五灵脂（C错）为十九畏中的药味。十九畏列述了九组十九味相反药，具体是：硫黄畏朴硝（包括芒硝、玄明粉），水银畏砒霜，狼毒畏密陀僧，巴豆（包括巴豆霜）畏牵牛子（包括黑丑、白丑），丁香（包括母丁香）畏郁金，川乌（包括附子）、草乌畏犀角，芒硝（包括玄明粉）畏三棱，官桂畏石脂，人参畏五灵脂。